患儿，3岁。大便稀溏，食入即泻，面色萎黄。治疗应首选
A. 保和丸
B. 理中丸
C. 四君子汤
D. 参苓白术散
E. 曲麦枳术丸

正确答案：D。参苓白术散

解析：患儿大便稀溏，属“泄泻”范畴，其食入即泻，面色萎黄均呈脾虚之象，本证常由暴泻失治迁延而成，脾气虚弱，运化失常，水液停滞为水湿，食谷停为积滞，杂合而下，则大便稀溏，食入即泻；气血生化无源，则见面色萎黄，治宜健脾益气，渗湿止泻，应选用参苓白术散（D对）。保和丸适于小儿的伤食泻，症见大便稀溏，夹有乳凝块或食物残渣，气味酸臭，或如败卵（A错）。理中丸温中散寒，补气健脾，主治脾胃虚寒证，见呕吐泄泻，胸满腹痛及阳虚失血等症（B错）。四君子汤补气健脾，适于脾胃气虚所致面色萎白，食少便溏（C错）。曲麦枳术丸健脾消食，适于脾虚停滞，脘腹痞满，倒饱嘈杂，不思饮食（E错）。